翼内肌下部触诊位置在
A. 下颌升支外侧
B. 下颌升支前缘向上
C. 下颌磨牙舌侧后下方和下颌支内侧面
D. 乙状切迹中点与颧弓中点之间
E. 上颌结节后上方

正确答案：C。下颌磨牙舌侧后下方和下颌支内侧面

解析：本题考查颞下颌关节检查。在口内，翼内肌下部触诊位置在下颌磨牙舌侧后下方和下颌支内侧面（C对），下颌升支前缘向上（B错）可扪触颞肌前份，上颌结节后上方（E错）可扪触翼外肌下头。下颌升支外侧（A错）和乙状切迹中点与颧弓中点之间（D错）可扪触咬肌。